对儿童接种易感疫苗后，评价效果可选用指标
A. 罹患率、患病率
B. 死亡率，病死率
C. 相对危险度、特异危险度
D. 有效率，治愈率
E. 抗体阳转率、保护率

正确答案：E。抗体阳转率、保护率